产生温室效应的气体不包括
A. CO₂
B. 甲烷
C. 氧化亚氮（N₂O）
D. HCl
E. 含氯氟烃（氟利昂，CFCs）

正确答案：D。HCl

解析：本题考查产生温室效应的气体。大气层中某些气体能吸收地表发射的热辐射，使大气增温，称为温室效应。这些气体统称为温室气体，主要包括CO₂（A对）、甲烷（CH₄）（B对）、氧化亚氮（N₂O）（C对）和氯氟烃（CFC）（E对）等。HCl（D错，为本题正确答案）不是温室气体，不具有辐射吸收和辐射吸热的能力，不会对发生温室效应产生影响。